研究化学毒物的化学结构与毒性效应之间的关系
A. 有助于从分子水平乃至量子水平阐明化学毒物的毒物机制
B. 有助于指导新的化学物质或药物的设计和合成
C. 有助于指导解毒药物的筛选
D. 有助于预估新化学物质的安全限量标准范围
E. 以上都是

正确答案：E。以上都是